女性，38岁，糖尿病12年，每日皮下注射人混合胰岛素治疗，早餐前30单位，晚餐前24单位，每日进餐规律，主食量300g。近来空腹血糖12.5mmol/L，餐后血糖7.6～9.0mmol/L。较为合适的处理是
A. 调整进餐量
B. 胰岛素调整剂量
C. 加磺脲类降糖药物
D. 加双胍类降糖药物
E. 改用口服降糖药

正确答案：B。胰岛素调整剂量

解析：患者规律使用胰岛素替代治疗与饮食治疗后出现空腹高血糖，餐后血糖控制尚可，最可能的原因为夜间出现低血糖继发的反跳性高血糖或由于清晨升糖激素增多引起的高血糖即Somogyi效应或黎明现象。对于Somogyi效应可适度减少胰岛素剂量，对于黎明现象可适当增加胰岛素剂量，因此对于患者较为合适的处理为调整胰岛素剂量（B对）。患者每日进食规律，餐后血糖控制理想，无需调整进餐量（A错）。患者仅空腹血糖升高，餐后血糖控制理想，说明单用胰岛素治疗即可，无需加用口服降糖药物（CD错）。患者慢性糖尿病多年病史，已使用胰岛素治疗，说明其胰岛功能出现减退，改用口服降糖药物（E错）控制血糖效果不好。